翼外肌痉挛开口型
A. 偏向患侧
B. 偏向健侧
C. 先偏向患侧后又回到中线
D. 不偏
E. 开口型歪曲

正确答案：A。偏向患侧

解析：翼外肌痉挛：关节区或关节周围开口及咀嚼痛，一般无自发痛。检查时可见开口中度受限，开口型偏向患侧，被动开口度大于自然开口度。一般无关节弹响，但髁突动度明显减小。掌握“颞下颌关节紊乱”知识点。